与瞳孔对光反射有关的是
A. 瞳孔开大肌肉
B. 瞳孔括约肌
C. 眼神经
D. 距状沟上下区
E. 无

正确答案：B。瞳孔括约肌

解析：瞳孔对光反射的通路如下：视网膜—视神经一视交叉一视束一上丘臂一顶盖前区一两侧动眼神经副核一动眼神经一睫状神经节一节后纤维一瞳孔括约肌收缩（B对）一两侧瞳孔缩小。所以与瞳孔对光反射有关的是瞳孔括约肌。瞳孔开大肌肉（A错）由交感神经支配，其收缩时使瞳孔扩大。眼神经（C错）为三叉神经的分支之一。距状沟上下区（D错）的视区皮质为视觉感受区，产生视觉。